片剂中兼有黏合和崩解作用的辅料是
A. PEG
B. PVP
C. HPMC
D. MCC
E. L-HPC

正确答案：D。MCC

解析：本题考查片剂的常用辅料。微晶纤维素（D对）主要在口服片剂和胶囊中用作填充剂和黏合剂，不仅可用于湿法制粒也可用于干法直接压片。还有一定的润滑和崩解作用，在片剂制备中非常有用。MCC具有很好的结合力和抗压性，有“干黏合剂”之称，且浓度为5～20%时具有崩解的效果。PEG（聚乙二醇类）（A错）是常用的润滑剂。PVP（聚维酮）（B错）是常用的黏合剂。HPMC（羟丙甲纤维素）（C错）是常用的黏合剂。L-HPC（低取代羟丙基纤维素）（E错）是常用的崩解剂。